男，40岁。持续高热8天，伴恶心、纳差、腹泻。查体：皮肤巩膜无黄染，前胸部可见散在的淡红色斑丘疹，脾肋下可触及，质软、有压痛。实验室俭查：血WBC3.2×10⁹/L，N0.72，L0.25，E0，PLT120×10⁹/L，ALT108U/L，TBiI12µmoI/L。为确定诊断，最有意义的检查是
A. 粪培养
B. 外斐试验
C. 汉坦病毒特异性抗体
D. 肝炎病毒标志物
E. 血培养

正确答案：E。血培养

解析：中年男性患者，持续高热、恶心、纳差、腹泻，前胸部可见散在的淡红色斑丘疹（玫瑰疹），脾大，质软、有压痛。血WBC减少，E（嗜酸性粒细胞）消失，ALT升高。最可能的诊断是伤寒。为确定诊断，最有意义的检查是血培养（E对）和骨髓培养。该患者发病时间为8天，血培养在病程第1~2周阳性率最高，可达80%~90%。粪便培养（A错）在病程第2周起阳性率逐渐增加，第3~4周阳性最高。肥达试验对伤寒有辅助诊断意义。外斐试验（B错）为斑疹伤寒的诊断试验。汉坦病毒特异性抗体（C错）用于诊断肾综合征出血热。